男，26岁。近1个月来兴高采烈，话多，自觉脑子聪明，无疲倦感。其主要表现为
A. 焦虑症状
B. 不协调性精神运动兴奋
C. 协调性精神运动兴奋
D. 强迫症状
E. 思维内容障碍

正确答案：C。协调性精神运动兴奋

解析：该患者近1个月来兴高采烈，话多（言语增多），自觉脑子聪明，无疲倦感，表现为协调性精神运动兴奋（C对）。焦虑表现为患者顾虑重重、紧张恐惧，坐立不安，严重时可表现为搓手顿足，惶惶不可终日，似有大祸临头的感觉，常伴有心悸、出汗、手抖、尿频等自主神经功能紊乱症状（A错）。不协调性精神运动兴奋表现为患者增多的动作作为及言语与思维、情感、意志等精神活动不相协调，脱离周围现实环境（B错）。